一颌面外伤患者，经检查发现外耳道流血性液体，渐转清亮液体。该液体很可能是
A. 脑脊液
B. 血液
C. 组织渗出液
D. 外耳道分泌物
E. 其他

正确答案：A。脑脊液

解析：本题考查鼻骨骨折。一颌面外伤患者，经检查发现外耳道流血性液体，渐转清亮液体。该液体很可能是脑脊液（A对）。鼻骨骨折伴有筛骨损伤或伴前颅窝骨折时，可发生脑脊液鼻瘘。初期为混有血液的脑脊液外渗（B错），以后则血液减少或只有清亮的脑脊液流出。组织渗出液多为深黄色浑浊、血性、脓性液体（C错）。外耳道分泌物多呈油性或黏稠状固体（D错）。